患儿，男，4岁、因高热、皮疹就诊，体温39.1℃，诊断为水痘，经物理降温无效。适宜选用的退热药有
A. 阿司匹林泡腾片
B. 布洛芬混悬液
C. 安乃近片
D. 尼美舒利颗粒
E. 对乙酰氨基酚滴剂

正确答案：B、E。布洛芬混悬液；对乙酰氨基酚滴剂

解析：本题考查退热药。适宜选用的退热药有布洛芬混悬液（B对）、对乙酰氨基酚滴剂（E对）。世界卫生组织建议，两个月以内的婴儿禁用任何退热药。儿童体温达到39℃、经物理降温无效时，可适当用药，最好选用含布洛芬的混悬液或含对乙酰氨基酚的滴剂。阿司匹林（A错）避免用于儿童退热，可能引起Reye's综合征。安乃近（C错）滴鼻用于5岁以下儿童高热时紧急退热治疗。尼美舒利（D错）颗粒禁用于12岁以下儿童。